应大力提倡的喂养方式是
A. 母乳喂养
B. 牛乳喂养
C. 婴儿配方奶粉
D. 羊乳喂养
E. 马乳喂养

正确答案：A。母乳喂养

解析：母乳是婴儿（尤其是6个月以下的婴儿）最适宜的天然食物，对婴儿的健康生长发育有不可替代的作用。应大力提倡母乳喂养，宣传母乳喂养的优点。掌握“婴儿喂养方法”知识点。